厥阴之为病
A. 脉微细，但欲寐也
B. 消渴，气上撞心，心中疼热，饥而不欲食，食则吐蛔。下之利不止
C. 腹满而吐，食不下，自利益甚，时腹自痛
D. 口苦，咽干，目眩也
E. 胃家实是也

正确答案：B。消渴，气上撞心，心中疼热，饥而不欲食，食则吐蛔。下之利不止

解析：B选项所述为上寒下热的症状，上热，为胃中有热，表现为消渴，气上撞心，心中疼热；下寒，为肠中有寒，表现为饥而不欲食，食则吐蛔。邪入厥阴，阴阳交争，寒热错杂，阳热趋上，灼伤阴津，故见消渴不止；肝热上逆，上冲胃脘，则自觉气上撞心，心中疼热；阴寒趋下，脾失健运，更因肝木之乘，胃失和降，中焦气机逆乱，故见饥而不欲食，强食则吐；上热下寒，蛔虫不安，则可随呕吐而出（B对）。脉微细，但欲寐也（A错）为少阴病的提纲证。腹满而吐，食不下，自利益甚，时腹自痛（C错）为太阴病的提纲证。口苦，咽干，目眩也（D错）为少阳病的提纲证。胃家实是也（E错）为阳明病的提纲证。